脐上4寸，前正中线旁开2寸的腧穴是
A. 不容
B. 承满
C. 梁门
D. 关门
E. 滑肉门

正确答案：C。梁门

解析：梁门为足阳明胃经的穴位，位于脐上4寸，前正中线旁开2寸（C对）。不容位于脐中上6寸，前正中线旁开2寸（A错）。承满位于脐中上5寸，前正中线旁开2寸（B错）。关门位于脐中上3寸，前正中线旁开2寸（D错）。滑肉门位于脐中上1寸，前正中线旁开2寸（错）。